临床上牙髓息肉一般见于
A. 急性牙髓炎浆液期
B. 急性牙髓炎化脓期
C. 慢性闭锁性牙髓炎
D. 慢性溃疡性牙髓炎
E. 慢性增生性牙髓炎

正确答案：E。慢性增生性牙髓炎

解析：本题考查慢性增生性牙髓炎。慢性增生牙髓炎当根尖孔粗大，血运丰富以及穿髓孔较大，可出现牙髓息肉（E对）。急性牙髓炎可表现为自发性阵发性疼痛，夜间痛，冷热刺激加剧疼痛，疼痛不能自行定位，有浆液期和化脓期，化脓期患者可有热痛冷缓解的表现，急性牙髓炎无牙髓息肉（AB错）。慢性闭锁性牙髓炎的对温度刺激的反应为敏感，也可为迟热测引起的迟缓性疼痛，无牙髓息肉（C错）。慢性溃疡型牙髓炎食物入洞以及冷热刺激引起剧烈疼痛，无牙髓息肉（D错）。